在流行病学研究中，由因到果的研究为
A. 生态学研究
B. 筛检
C. 队列研究
D. 现状研究
E. 病例对照研究

正确答案：C。队列研究

解析：在流行病学研究中，队列研究（C对）是由因到果的研究方式。队列研究（C对）的优点：①属于直接观察法：②一次调查可观察多种结局：③由因到果：④有对照组，能确证暴露与疾病的因果联系。现状研究（D错）只能将收集到的数据加以直观的描述，并不一定是由因到果的研究。病例对照研究（E错）可追溯研究对象既往可疑危险因素暴露史，其研究方向是回顾性的，是由“果”至“因”的。生态学研究（A错）中最为简单的方法是观察不同人群或地区某种疾病的分布，然后根据疾病分布的差异，提出病因假设，可见也是一种由果到因的研究方法。筛检（B错）注重检查的结果，并非由因到果的研究。